味觉感受器的基本味觉不包括
A. 酸
B. 甜
C. 苦
D. 辣
E. 咸

正确答案：D。辣

解析：味觉感受器一般有酸、甜、苦、咸四种基本味觉。掌握“口腔感觉”知识点。